在直线回归分析中，如果算得回归系数b＞0，则
A. 不需要进行假设检验确定β是否等于零
B. 还需进行假设检验确定β是否等于零
C. β大于0
D. β等于0
E. β小于0

正确答案：B。还需进行假设检验确定β是否等于零

解析：在直线回归分析中，由样本资料计算的回归系数b和其他统计量一样，存在抽样误差，即使总体回归系数β=0，由样本资料计算的回归系数b也不可能恰好等于0。因此，当回归系数b＞0，甚至b为任意值时均需要进行假设检验确定β是否等于零（B对）。